在慢性支气管炎的预防中，最重要的预防措施之一是
A. 戒酒
B. 减少钠离子摄入
C. 减少糖类摄入
D. 减少外出
E. 戒烟

正确答案：E。戒烟

解析：慢性支气管炎的预防主要是避免发病的高危因素，减少急性发作的诱因，增加自身免疫力。其中戒烟是最重要的措施之一，有利于防止肺气肿、肺心病并发症的发作与发展。掌握“慢性支气管炎”知识点。